56岁，男性患者，自述间歇无痛性肉眼血尿3个月来门诊就诊。查体：一般状态好，轻度贫血貌，双肾未触及，膀胱区叩诊清音。该病例临床诊断首先考虑
A. 尿路感染
B. 前列腺增生症
C. 泌尿系结核
D. 膀胱结石
E. 泌尿系肿瘤，以膀胱肿瘤可能性大

正确答案：E。泌尿系肿瘤，以膀胱肿瘤可能性大

解析：中年男性患者，间歇无痛性肉眼血尿、轻度贫血貌（提示可能有泌尿系肿瘤），双肾未触及，结合患者病史和体查，该病例临床诊断首先考虑泌尿系肿瘤，以膀胱肿瘤可能性大（E对）（膀胱肿瘤是泌尿系统最常见的肿瘤，多发生于中老年男性）。尿路感染（A错）主要表现为尿频尿急尿痛的膀胱刺激症状。前列腺增生（B错）主要表现为尿频，进行性排尿困难。泌尿系结核（C错）典型表现为膀胱刺激症状伴终末血尿，患者可有低热、盗汗等结核中毒症状。膀胱结石（D错）主要表现为排尿突然中断，疼痛放射至远端尿道及阴茎头部，伴排尿困难和膀胱刺激症状。